《素问·生气通天论》有“阴者，藏精而起亟也；阳者，卫外而为固也”，主要说明
A. 阴精和阳气的病理关系
B. 阴精和阳气各自的生理功能
C. 阴阳的对立
D. 阴阳的偏盛
E. 阴精和阳气的生理关系

正确答案：E。阴精和阳气的生理关系

解析：全句意为阴精不断地起而与阳气相应；阳气为阴精而固密于外。本句说明人体阴阳在生理上相互依存、相互为用的关系（E对）。阴是体内贮藏的精微物质，为养护阳气的物质基础；而阳在人体中具有卫护于外，从而起着使体表固密并使阴精安守于内的作用。